T淋巴细胞不具备的表面标志是
A. CD4
B. CD3
C. CD8
D. CD80（B7）
E. TCR

正确答案：D。CD80（B7）

解析：其他几项均是，不包括CD80（B7）。掌握“T淋巴细胞”知识点。